咳嗽阵作，痰中带血或纯血鲜红，胸胁胀痛，烦躁易怒，口苦，舌红苔薄黄，脉弦数。治疗应首选
A. 加减泻白散合黛蛤散
B. 龙胆泻肝汤
C. 柴胡疏肝散
D. 丹栀逍遥散
E. 滋水清肝饮

正确答案：A。加减泻白散合黛蛤散

解析：患者以咳嗽阵作为主症，故诊断为咳嗽。肝郁化火，上逆侮肺，肺失肃降,故咳逆阵作；木火刑金，炼液成痰，灼伤肺络，故痰中带血或纯血鲜红；肝脉布两胁，上注于肺，肝肺络气不和，故胸胁胀痛；肝火扰心，肝失疏泄，情志失调，故烦躁易怒；肝火上炎，故口苦；舌红苔薄黄，脉弦数，皆为肝火犯肺之征，诊断为肝火犯肺证。治以清肺泻肝、顺气降火， 代表方为加减泻白散合黛蛤散（A对）。龙胆泻肝汤，其功用为清泻肝胆实火，清利肝胆湿热，可用于不寐之肝火扰心证、鼻衄之肝火上炎证或早泄之肝经湿热证或吐血之肝火犯胃证(B错)。柴胡疏肝散，其功用为疏肝理气，活血止痛，可用于郁证之肝气郁结证（C错）。丹栀逍遥散，其功用为疏肝解郁，清泻肝火，可用于郁证之气郁化火证（D错）。滋水清肝饮，其功用为滋阴清火，可用于郁证之气郁化火伤阴证（E错）。